苷元为三萜苷类化合物的是
A. 大豆苷
B. 栀子苷
C. 甘草皂苷
D. 甜菊苷
E. 金丝桃苷

正确答案：C。甘草皂苷

解析：本题考查的是甘草的主要化学成分。苷元为三萜苷类化合物的是甘草皂苷（C对）。三萜皂苷由三萜皂苷元和糖组成，苷元为三萜类化合物，其基本骨架由6个异戊二烯单位组成。含三萜皂苷的常用中药有人参、三七、甘草、黄芪、合欢皮、商陆和柴胡等。甘草所含的三萜皂苷以甘草皂苷含量最高。甘草皂苷又称甘草酸，为甘草中的甜味成分。《中国药典》以甘草苷和甘草酸为指标成分，控制甘草和炙甘草的质量，其中甘草苷为黄酮苷，并要求甘草和炙甘草的甘草苷含量均不得少于0.50%，甘草中甘草酸的含量不得少于2.0%，炙甘草中甘草酸的含量不得少于1.0%。大豆苷（A错）为葛根的主要成分，属于异黄酮类化合物。葛根含异黄酮类化合物，主要成分有大豆素、大豆苷、大豆素-7，4'-二葡萄糖苷及葛根素、葛根素-7-木糖苷。《中国药典》以葛根素为指标成分进行含量测定，要求含葛根素不得少于2.4%。栀子苷（B错）为栀子的化学成分，属于环烯醚萜类化合物。甜菊苷（D错）为甜叶菊的化学成分，属于四环二萜类化合物。金丝桃苷（E错）为满山红的化学成分。满山红叶中含有杜鹃素、8-去甲基杜鹃素、山柰酚、槲皮素、杨梅素、金丝桃苷、异金丝桃苷以及莨菪亭、伞形酮、木毒素、牻牛儿酮、薄荷醇、杜松脑和α-桉叶醇、β-桉叶醇、γ-桉叶醇等。《中国药典》以杜鹃素为对照品对满山红进行含量测定。要求杜鹃素含量不少于0.08%。